两相溶剂萃取法分离混合物中各组分的原理是
A. 各组分的结构类型不同
B. 各组分的分配系数不同
C. 各组分的化学性质不同
D. 两相溶剂的极性相差大
E. 两相溶剂的极性相差小

正确答案：B。各组分的分配系数不同

解析：本题考查的是液-液萃取法的分离的原理。两相溶剂萃取法分离混合物中各组分的原理是各组分的分配系数不同（B对）。液-液萃取法：液-液萃取法根据物质在两相溶剂中的分配比不同进行分离。该方法也简称萃取法。分配系数K值：两种相互不能任意混溶的溶剂（例如三氯甲烷与水）如置分液漏斗中充分振摇，放置后即可分成两相。此时如果其中含有溶质，则溶质在两相溶剂中的分配比（K）在一定温度及压力下为一常数。